男，58岁。高热两天，咳嗽，咳铁锈色痰，白细胞增高，胸片呈左上肺片状阴影。最有可能的诊断是
A. 军团菌肺炎
B. 肺曲菌肺炎
C. 肺炎链球菌肺炎
D. 卡氏囊虫肺炎
E. 肺孢子菌肺炎

正确答案：C。肺炎链球菌肺炎

解析：患者为中老年男性，起病急骤，高热、咳嗽，咳铁锈色痰（为肺炎链球菌肺炎典型的痰液表现），胸片呈左上肺片状阴影（为肺炎链球菌肺炎典型的胸片改变），根据临床表现、痰液的特点以及胸片的表现，可初步诊断为肺炎链球菌肺炎（C对）。军团菌肺炎（A错）表现为高热、肌痛及相对缓脉，无铁锈色痰。肺曲菌肺炎（B错）主要症状为干咳、胸痛，或有咯血，病变严重时可有喘气、呼吸困难，甚至呼吸衰竭，部分患者可出现中枢神经系统感染。肺孢子菌肺炎又称卡氏囊虫肺炎（P57）（DE错）多见于早产儿、营养不良儿和免疫缺陷者，主要表现为食欲下降、腹泻等，X线表现早期为弥漫性肺泡和间质浸润影，迅速进展为双侧肺门蝴蝶状影，可见支气管充气征（DE错）。